在不能保存健康生活牙髓时，应尽力
A. 保存牙髓
B. 保存根髓
C. 保存牙齿
D. 拔除
E. 牙周手术

正确答案：C。保存牙齿

解析：在不能保存健康生活牙髓时，应去除病变牙髓，尽力保存患牙，以维持牙列完整，维护咀嚼功能。掌握“牙髓根尖周病的治疗总论”知识点。